有关甲状软骨的说法,何者不正确
A. 是喉软骨中最大的一对软骨
B. 左、右侧甲状软骨板前缘相交形成前角，又称喉结
C. 下角与杓状软骨形成关节
D. 借环甲膜连于舌骨
E. 甲状软骨板上缘平对第4颈椎

正确答案：D。借环甲膜连于舌骨

解析：甲状软骨是最大的喉软骨（A对）。左、右侧甲状软骨板前缘相交形成前角，又称喉结（B对）。甲状软骨下角较短，与环状软骨相关节（C对）。甲状软骨借甲状舌骨膜连于舌骨（D错，为本题正确答案）。